男，32岁。支气管哮喘，20年。喘息加重1周。意识恍惚1天来急诊。查体：T37.5℃，P94/分，面色暗红，口唇发绀。可见胸腹矛盾运动，双肺呼吸音低，可闻及低调哮鸣音。该患者首选的治疗措施是
A. 大剂量糖皮质激素静脉点滴
B. 气管插管、机械通气
C. β₂受体激动剂雾化吸入
D. 面罩吸氧
E. 无创通气

正确答案：B。气管插管、机械通气

解析：该患者病情危重，此时最可能出现的动脉血气变化为PaO₂降低、PaCO₂升高、PH降低。该患者首选的治疗措施是气管插管、机械通气（B对）。